男性，8岁。发热，胸痛，气短一周余，查体：右胸部饱满，叩诊呈浊音，右胸呼吸音减弱，实验室检查：白细胞20×10⁹/L，中性粒细胞分数90%，胸透示：右胸腔积液。应首先考虑
A. 胸导管损伤
B. 急性脓胸
C. 癌性胸膜炎
D. 急性左心力衰竭
E. 结核性胸膜炎

正确答案：B。急性脓胸

解析：患者为男性儿童，发热，胸痛，气短，右侧胸腔积液，白细胞20×10⁹/L（正常4～10×10⁹/L），中性粒细胞分数90%（正常为50%～70%），提示有感染，应首先考虑急性脓胸（B对）。胸导管损伤（A错）引发乳糜胸，实验室检查镜检可见到淋巴细胞和红细胞，中性粒细胞罕见。癌性胸膜炎（P119）（C错）多见于中年以上的患者，伴有消瘦和原发部位肿瘤的症状，且胸腔积液以淋巴细胞为主。急性左心力衰竭（D错）所致的胸腔积液为漏出液，细胞计数常小于100×10⁶/L，有心功能不全的其他表现。结核性胸膜炎（E错）多见于青年人，常有发热、干咳、胸痛，胸腔积液以淋巴细胞为主。